更年安片既能滋阴清热，又能
A. 补气养血
B. 养血调经
C. 除烦安神
D. 活血止痛
E. 养心安神

正确答案：C。除烦安神

解析：本题考查的是更年安片的功能。更年安片既能滋阴清热，又能除烦安神（C对）。更年安片：【功能】滋阴清热，除烦安神。乌鸡白凤丸：【功能】补气养血（A错），调经（B错）止带。云南白药：【功能】化瘀止血，活血止痛（D错），解毒消肿。酸枣仁：【功效】养心安神（E错），敛汗。